某患者因抑郁用文拉法辛（75mg，bid）治疗，用药7天后自觉无效，前来咨询。下列药师用药指导意见，正确的是
A. 药物剂量太小，应增大剂量
B. 此药疗效差，建议换用氟西汀
C. 此药疗效差，建议换用丙咪嗪
D. 单一用药无效，建议联合使用氯米帕明
E. 抗抑郁药多数需要至少2周才会有显著的情绪改善，建议继续服药

正确答案：E。抗抑郁药多数需要至少2周才会有显著的情绪改善，建议继续服药

解析：本题考查抗抑郁药的使用。抗抑郁药多数需要至少2周才有显著的情绪反应，12周后才有完整的治疗效果（E对BC错）。抗抑郁药在应用时剂量应逐步递增，尽可能采用最小有效剂量，使不良反应减至最小（A错）。抗抑郁药在使用中尽量单一用药，应足量、足疗程治疗（D错）。